十二指肠球部
A. 又称十二指肠上部，约长2.5cm
B. 其肠壁厚、管径大
C. 粘膜面有丰富的环形皱襞
D. 是溃疡和穿孔的好发部位
E. 上述皆正确

正确答案：D。是溃疡和穿孔的好发部位

解析：十二指肠球为十二指肠上部近侧与幽门相接的一段2.5cm的肠管(A错)，其肠壁薄、管径大(B错)，粘膜面光滑无皱襞(C错)，是溃疡和穿孔的好发部位(D对)。